下列哪一项不是甲状腺激素的生物学作用
A. 提高大多数组织耗氧量
B. 促进糖原合成、抑制糖原分解
C. 促进脑的发育、生长
D. 刺激骨化中心发育和软骨骨化
E. 增加心脏做功

正确答案：B。促进糖原合成、抑制糖原分解